口服不吸收，临床主要用于绿脓杆菌感染治疗
A. 青霉素V
B. 苯唑西林
C. 替卡西林
D. 哌拉西林
E. 舒巴坦

正确答案：C。替卡西林